婴儿接种乙肝疫苗第3针的年龄是
A. 3月龄
B. 4月龄
C. 5月龄
D. 6月龄
E. 8月龄

正确答案：D。6月龄

解析：本题考查乙肝疫苗的接种时间。乙肝疫苗共接种3剂次，其中第1剂在新生儿出生后24小时内接种，第2剂在1月龄时接种，第3剂在6月龄（D对ABCE错）时接种。